男性，50岁。左胸闷气短2月，胸痛20天，夜间重，查体颜面及颈部胸壁略肿胀，胸壁静脉曲张，腋下有一拇指大小的淋巴结，无压痛，活动尚好，心率108次/分，律整，左肺呼吸音消失。采取哪项措施缓解的病人呼吸困难
A. 静脉注射快速利尿剂
B. 缓慢静脉注射毛花苷丙
C. 静脉注射激素类药物
D. 胸腔排液减压
E. 合理吸氧

正确答案：D。胸腔排液减压

解析：患者为中老年男性，左胸闷气2月，胸痛20天，夜间重，查体颜面及颈部胸壁略肿胀，胸壁静脉曲张，腋下有一拇指大小的活动度好无压痛的淋巴结，左肺呼吸音消失等符合左癌性胸膜炎的临床表现及体格检查，故诊断为左癌性胸膜炎（癌性胸膜炎为胸内或胸外癌肿直接侵犯或转移到胸膜引起的，多无发热症状，有胸闷及进行性呼吸困难，胸液多为血性，并可找到癌细胞，可有淋巴结肿大等表现）。炎性渗出可导致胸腔积液的量增多，从而导致病人呼吸困难，为缓解病人的呼吸困难，应胸腔排液减压（D对）。而静脉注射快速利尿剂（P175）（A错）常用于急性心力衰竭的治疗。缓慢静脉注射毛花甘丙（P172）（B错）常用于伴有快速心房颤动/心房扑动的收缩性心力衰竭的患者。静脉注射激素类药物（C错）可用于肾病综合征、系统性红斑狼疮等的治疗。合理吸氧（E错）常用于呼吸衰竭或酸中毒的病人。